射击运动员使用后，可减慢心率，减少心肌耗氧量，消除比赛前紧张心理，因此被列入兴奋剂管理的药物是
A. 缬沙坦
B. 呋塞米
C. 普萘洛尔
D. 硝苯地平
E. 卡托普利

正确答案：C。普萘洛尔

解析：本题考查兴奋剂的使用。普萘洛尔（C对）为β受体阻断剂，可降低血压、减慢心率、减少心肌耗氧量，增加人体平衡功能、增强运动耐力，尤其能消除运动员比赛前的紧张心理。呋塞米（B错）属于利尿剂，可帮助人在短时间内急速降低体重，易造成人体严重脱水、肾衰竭。缬沙坦（A错）、硝苯地平（D错）、卡托普利（E错）为降压药，不属于兴奋剂。